脊髓灰质炎活疫苗试验结果表明：接种疫苗组儿童脊髓灰质炎的发病率是16/10万，接受安慰剂组儿童的发病率是57/10万，因此该疫苗的效果指数是
A. 3.6
B. 0.72
C. 0.28
D. 0.61
E. 2

正确答案：A。3.6

解析：本题考查效果指数的计算。效果指数＝对照组发病（或死亡）率/实验组发病（或死亡）率＝（57/10万）/（16/10万）＝3.6（A对BCDE错）。